甲是药品零售连锁企业，下辖300余家直营门店，经营类别为处方药、甲类非处方药、乙类非处方药；经营范围为中药饮片、化学药、生物制品、中成药。甲有自建网站，2011年取得《互联网药品信息服务资格证书》，2012年取得《互联网药品交易服务资格证书》，获准通过自建网站开展网络药品销售活动。关于甲总部和所属门店经营类别及经营范围的说法，正确的是
A. 各直营门店不需取得独立的药品经营许可证，其经营类别及经营范围与甲总部一致
B. 各直营门店都应取得独立的药品经营许可证，其经营类别及经营范围应当与甲总部一致
C. 各直营门店都应取得独立的药品经营许可证，经营类别应当与甲总部一致，经营范围可以与甲总部不一致
D. 各直营门店都应取得独立的药品经营许可证，其经营类别及经营范围严禁超过甲总部

正确答案：D。各直营门店都应取得独立的药品经营许可证，其经营类别及经营范围严禁超过甲总部

解析：本题考查的是药品经营范围。甲是药品零售连锁企业，下辖300余家直营门店，经营类别为处方药、甲类非处方药、乙类非处方药；经营范围为中药饮片、化学药、生物制品、中成药。甲有自建网站，2011年取得《互联网药品信息服务资格证书》，2012年取得《互联网药品交易服务资格证书》，获准通过自建网站开展网络药品销售活动。关于甲总部和所属门店经营类别及经营范围的说法，正确的是各直营门店都应取得独立的药品经营许可证，其经营类别及经营范围严禁超过甲总部（D对）。药品批发企业的许可：开办药品批发企业（含药品零售连锁企业总部）的，应当向省级药品监督管理部门申请，经审批同意，依法获取《药品经营许可证》后，方可开展相应药品经营活动。药品零售企业的许可：开办药品零售企业（含药品零售连锁企业门店）的，应当向县级以上药品监督管理部门申请，经审批同意，依法获取《药品经营许可证》后，方可开展相应药品经营活动（A错）。药品零售连锁企业总部药品经营活动：药品零售连锁企业总部应当对所属零售门店建立统一的质量管理体系，在计算机系统、采购配送、票据管理、药学服务等方面统一管理。药品零售连锁企业总部的经营活动，应当执行药品批发企业管理的相关要求。（1）统一采购：药品零售连锁企业总部负责对购进药品、供货单位及其销售人员的合法资质进行审核，并统一采购药品（BC错）。（2）统一质量管理：药品零售连锁企业总部负责设立与经营实际相适应的组织机构或岗位，明确规定其职责、权限及相互关系，制定质量管理体系文件，指导、监督文件的执行，开展质量策划、质量控制、质量保证、质量改进和质量风险管理等活动，并对门店的经营行为和质量管理负责。（3）统一配送：门店应当通过计算机系统向总部提出要货计划，由总部统一进行配送；总部也可根据计算机系统中门店药品库存和销售情况，下达配货指令，直接向门店配送药品。配送过程应当符合药品GSP有关要求。（4）统一计算机系统：药品零售连锁企业总部建立的计算机系统应当能够对其总部和门店实施统一管理。计算机系统除符合药品GSP及其附录的要求外，还应当符合以下要求：实现总部与门店间的信息传输、数据共享等功能，数据应当做到双向、实时、自动传输；不得支持门店自行采购药品的操作；不得支持门店自行解除由总部做出的质量控制和药品锁定指令；不支持门店间信息显示和业务往来。药品零售连锁企业总部质量管理部门负责计算机系统操作权限的审核、控制及质量管理基础数据库的建立、维护及更新：基础数据库应当符合药品GSP及其附录规定的相关要求，还应当包括门店名称、门店验收人员、门店经营范围及品种等内容；基础数据与对应的门店及所配送药品的合法性、有效性相关联，与门店的经营范围及品种相对应，由系统进行自动跟踪、识别与控制；门店使用的质量管理基础数据库应当由总部统一进行维护。（5）统一票据管理：药品零售连锁企业总部应当统一门店销售凭证式样。门店销售药品时，应当通过计算机系统自动生成注明各门店名称的销售票据。（6）统一药学服务标准药品零售连锁企业总部应当制定并督促执行统一的药学服务标准，并负责统一培训和药学服务管理，各门店应当按照标准开展药学服务。